空悬釉柱的处理原则是
A. 予以去除
B. 全部保留
C. 降低高度
D. 以上都不是

正确答案：A。予以去除

解析：本题考查窝洞的抗力形。空悬釉柱指无牙本质支持的牙釉质，在承受咬合力时易折裂，一般应予以去除（A对BD错）。降低高度，虽然在单纯咬合时与对颌牙无接触，不会发生折裂，但在咀嚼食物时直接受力仍会折裂（C错）。